尖锐湿疣的病原体主要是
A. HPV-1
B. HPV-2
C. HPV-6
D. HPV-16
E. HPV-31

正确答案：C。HPV-6